在下述各项中，不符合有利原则的是
A. 医务人员的行动与解除病人的疾苦有关
B. 医务人员的行动使病人受益而可能给别的病人带来损害
C. 医务人员的行动使病人受益而会给家庭带来-定的经济负担
D. 医务人员的行动可能解除病人的痛苦
E. 受病人或家庭条件的限制，医务人员选择的诊治手段不是最佳的

正确答案：B。医务人员的行动使病人受益而可能给别的病人带来损害

解析：有利原则指把病人的健康放在第一位，要求医生在权衡利益时对利害得失全面权衡，遵守最优化原则，医生使某个病人受益的同时，不能损害其他病人（B错，为本题正确答案）。医务人员的行动与解除病人的疾苦有关（A对），属于有利原则。在医疗过程中，或多或少会产生一些医疗费用，医务人员的行动使病人受益而会给家庭带来一定的经济负担（C对）、医务人员的行动可能解除病人的痛苦（D对）也属于有利原则。利益最大化要求医务人员的行动要抓住问题的主要矛盾，受病人或家庭条件的限制，医务人员选择的诊治手段不是最佳的（E对），但符合有利原则。